常用于腐败坏死性感染病原菌引起的口底蜂窝织炎脓腔冲洗的局部用药是
A. 复方硼砂液
B. 3％过氧化氢液
C. 10％过氧化氢液
D. 0.1％氯己定液
E. 0.5％氯己定液

正确答案：B。3％过氧化氢液

解析：本题考查口底多间隙感染脓腔冲洗的局部用药。腐败坏死性感染病原菌引起的口底蜂窝织炎脓腔冲洗的局部用药为3％过氧化氢液（B对C错），3％过氧化氢液遇到组织中的过氧化氢酶时可释放出新生氧，破坏腐败坏死性感染病原菌的生存环境，起到杀菌和除臭的作用，其发泡作用有助于创口内坏死组织的清除。复方硼砂液（A错）是用于口腔炎、咽炎、龈炎的消毒防腐药物。氯己定（DE错）为一种广谱抗菌剂，对腐败坏死性感染病原菌引起的口底蜂窝织炎冲洗效果欠佳。